一高中女生18岁，因乳房刺痛来医院就诊，诊室内除了一个女医生外还有一个男医学生，女医生未开口问诊，在让男医学生回避后才开始对患者问诊和查体。女医生在诊疗过程中体现了
A. 体贴关心，充分尊重
B. 过程耐心
C. 心正无私，正确引导
D. 全面系统，认真仔细
E. 态度热情

正确答案：A。体贴关心，充分尊重

解析：在让男医学生回避后才开始对患者问诊和查体（体现了尊重原则和体贴关心）（A对）。